口服葡萄糖耐量试验判断糖尿病标准为
A. 葡萄糖负荷后1小时血糖≥7.8mmol/L
B. 葡萄糖负荷后1小时血糖≥11.1mmoL/L
C. 葡萄糖负荷后2小时血糖≥7.8mmol/L
D. 葡萄糖负荷后2小时血糖≥11.1mmol/L
E. 葡萄糖负荷后3小时血糖≥7.8mmol/L

正确答案：D。葡萄糖负荷后2小时血糖≥11.1mmol/L